以下何器官通过所分泌的激素参与体内钙的调节
A. 甲状旁腺
B. 肾上腺
C. 脑垂体
D. 松果体
E. 无

正确答案：A。甲状旁腺

解析：甲状旁腺（A对）分泌甲状旁腺素，主要作用是调节体内钙和磷的代谢。